不属于子宫内膜癌的病理
A. 鳞癌
B. 粘液性癌
C. 透明细胞癌
D. 腺癌
E. 浆液性癌

正确答案：A。鳞癌

解析：子宫内膜癌的病理类型分为内膜样癌（D对）、浆液性癌（E对）、粘液性癌（B对）、透明细胞癌（C对）、癌肉瘤，鳞癌不属于子宫内膜癌的病理类型（A错，为本题的正确答案）。